25-D甾体皂苷元的IR特征是
A. 920～915CM⁻¹与899～894CM⁻¹的吸收强度相等
B. 920～915CM⁻¹与899～894CM⁻¹的吸收强度的3～4倍
C. 920～915CM⁻¹与899～894CM⁻¹的吸收强度的1/2
D. 920～915CM-1与899～894CM-1的吸收强度5倍
E. 920～915CM⁻¹与899～894CM⁻¹的吸收强度的6倍

正确答案：C。920～915CM⁻¹与899～894CM⁻¹的吸收强度的1/2

解析：本题考查的是甾体类化合物的IR光谱。25-D甾体皂苷元的IR特征是920～915CM⁻¹与899～894CM⁻¹的吸收强度的1/2（C对）。IR光谱可用于区分甾体皂苷C-25立体异构体。25-D型920～915CM⁻¹与899～894CM⁻¹的吸收强度的1/2。25-L型920～915CM⁻¹与899～894CM⁻¹的吸收强度的3～4倍（B错）。